根据《国家基本药物目录管理办法（暂行）》，国家基本药物目录中生物制品分类的主要依据是
A. 安全性评估结果
B. 药物经济学
C. 临床药理学
D. 药品通用名称
E. 临床治疗首选程度

正确答案：C。临床药理学

解析：本题考察生物制品分类依据。《国家基本药物目录管理办法（暂行）》第二条规定，化学药品和生物制品主要依据临床药理学（C对）分类，中成药主要依据功能分类。